关于队列研究的描述错误的是
A. 包括前瞻性研究
B. 将特定人群按是否暴露于某因素分组
C. 要计算发病率或死亡率
D. 不进行组间差异的统计学检验
E. 历史性队列研究要追溯到过去某时期的暴露史

正确答案：D。不进行组间差异的统计学检验

解析：队列研究是将一个范围明确的人群按照是否暴露于某可疑因素或暴露程度分为不同的亚组，追踪各组的结局并比较其差异，从而判断暴露因素与结局之间有无关联及关联程度大小的一种观察性研究方法。掌握“流行病学概论”知识点。